治疗长期不愈合的重型复发性阿弗他溃疡最常用的方法是
A. 口服抗生素
B. 10%硝酸银液局部烧灼
C. 曲安奈德混悬液局部注射
D. 手术切除病损
E. 氟康唑弧剂局部涂搽

正确答案：C。曲安奈德混悬液局部注射

解析：本题考查复发性阿氟他溃疡的治疗。治疗长期不愈合的重型复发性阿弗他溃疡最常用的方法是曲安奈德混悬液局部注射（C对）。对经久不愈或疼痛明显的MaRAU，常用曲安奈德混悬液加等量的2%利多卡因液作溃疡黏膜下封闭注射。RAU优先选择局部应用糖皮质激素治疗，一般不使用抗生素（A错）。10%的硝酸银用于龋病和牙本质过敏的治疗，对软组织具有较强腐蚀性（B错）。RAU有不治自愈的自限性，一般不需手术切除（D错）。氟康唑为抗真菌药，用于口腔念珠菌感染的治疗（E错）。